多见于宫颈糜烂愈合过程中的是
A. 移行带区
B. 原始鳞-柱交界部
C. 宫颈管柱状上皮
D. 宫颈上皮内瘤样病变
E. 鳞状上皮化

正确答案：E。鳞状上皮化

解析：宫颈糜烂愈合过程，即复层鳞状上皮移到单层柱状上皮外边，使宫颈变得光滑，这就是整个修复的过程（E对）；宫颈上皮是由宫颈阴道部鳞状上皮和宫颈管柱状上皮组成。宫颈阴道部鳞状上皮由深至浅分为基底层、中间层和浅表层。宫颈鳞状上皮与宫颈管柱状上皮交接部称为鳞-柱状交接部或鳞-柱交接部。青春期后，柱状上皮多外翻到宫颈阴道部，在阴道酸性环境中，柱状上皮被破坏，被化生的鳞状上皮所取代，形成新的鳞-柱交接部，称为生理鳞-柱交接部。鳞状上皮的化生通常从外翻上皮的原始鳞-柱交接部开始，也可在暴露的柱状上皮中呈岛状散布。此时原始鳞-柱交接部距宫颈外口较远，其与生理鳞-柱交接部之间的区域称为转化区，也称移行带。在转化区形成的过程中，未成熟的基底鳞状上皮细胞暴露在阴道环境中，易受 HPV病毒感染，病毒的早期基因在基底层细胞中表达，并随着鳞状上皮的分化成熟，使晚期基因得以在浅表层细胞中表达，从而完成病毒的复制过程。而高危型 HPV持续感染未成熟的基底鳞状化生细胞，可使其转化为核与胞浆异常的不典型细胞，即形成CIN的病理表现（ABCD错）。